为治湿痰要药的药物是
A. 半夏
B. 竹茹
C. 瓜蒌
D. 天南星
E. 旋覆花

正确答案：A。半夏

解析：本题考查的是半夏的性能特点。为治湿痰要药的药物是半夏（A对）。半夏：【性能特点】本品辛散温燥，有毒而力较强，入脾、胃、肺经，善祛脾胃湿痰。内服能燥湿化痰、降逆止呕、消痞散结，为治湿痰、寒痰、呕吐之要药，凡痰湿所致病证皆可选用，兼寒者最宜，兼热者当配苦寒之品。外用能攻毒散结而消肿，可治瘿瘤痰核及痈肿等。竹茹（B错）：【性能特点】本品甘而微寒，清化凉泄，药力较缓，入肺、胃、胆经。既清热化痰而止咳、除烦，为治痰热咳嗽及胆火挟痰之良药；又清胃而止呕，为治胃热呕吐之要药；还清热而安胎，为治胎热胎动所常用。瓜蒌（C错）：【性能特点】本品甘寒清泄滑润，清泄不苦燥，滑肠不峻下，甘润不滞气，入肺、胃、大肠经。既清肺润燥涤痰、利气宽胸开痹，又消肿散结、滑肠通便，善治肺热痰稠咳痰不易、胸痹结胸、乳痈、肺痈、肠痈，以及热结肠燥便秘。天南星（D错）：【性能特点】本品苦燥辛散，温化有毒，药力较强，入肺、肝、脾经。内服既燥湿化痰，治顽痰咳嗽；又祛风止痉，治风痰诸证及破伤风。湿痰、风痰皆宜，兼寒者尤佳，兼热者当配苦寒之品。生者外用攻毒、散结、消肿而止痛，治痈疽、瘰疬。功似半夏而力强，尤善祛经络风痰而止痉。治脾胃湿痰，以半夏为主天南星辅之；治经络风痰，以天南星为主半夏辅之。旋覆花（E错）：【性能特点】本品苦降辛散，微温咸软。主入肺、胃经，兼入脾与大肠经。既下气行水消痰，治痰涎壅肺之喘咳痰多、痰饮蓄结之胸膈痞满；又降胃气止呕哕，治噫气、呕吐。为治肺胃气逆之要药。